具有祛痰，止痛，解毒功效的药物是
A. 黄芩
B. 甘草
C. 白术
D. 大枣
E. 党参

正确答案：B。甘草

解析：甘草具有清热解毒，祛痰止咳，缓急止痛的功效（B对）。黄芩的功效是清热燥湿，泻火解毒，止血，安胎不具有祛痰止咳，缓急止痛的功效（A错）。白术的功效是健脾益气，燥湿利水，止汗，安胎的功效不具有清热解毒，祛痰止咳，缓急止痛的功效（C错）。大枣的功效是补中益气，养血安神不具有的清热解毒，祛痰止咳，缓急止痛功效（D错）。党参的功效是补脾肺气，补血,生津不具有清热解毒，祛痰止咳，缓急止痛的功效（E错）综上可知治疗祛痰，止痛，解毒功效的药物是甘草。